治疗带状疱疹宜选用的药物是
A. 拉米夫定
B. 金刚乙胺
C. 齐多夫定
D. 扎那米韦
E. 阿昔洛韦

正确答案：E。阿昔洛韦

解析：本题考查阿昔洛韦。阿昔洛韦（E对）为抗疱疹病毒药，主要用于单纯疱疹病毒引起的生殖器感染、皮肤黏膜感染、角膜炎及疱疹病毒脑炎和带状疱疹。拉米夫定（A错）用于治疗慢性乙肝。金刚乙胺（B错）可用于预防流感。齐多夫定（C错）主要用于治疗艾滋病以及HIV感染。扎那米韦（D错）用于防治流感病毒感染。